女，4个月。双胎之小，单纯母乳喂养，面色苍白，食欲减退2个月。查体：肤色苍白，肝肋下3.5厘米，脾肋下1.5厘米。血Hb80g/L，RBC3.3×10¹²/L，MCV60fl，MCH24pg，MCHC25%，Plt、WBC正常。若Hb恢复正常，还需要继续药物治疗的时间是
A. 3～4周
B. 1～2周
C. 9～12周
D. 13～18周
E. 6～8周

正确答案：E。6～8周

解析：该患儿血红蛋白80g/L可知为中度贫血，另外有肝脾稍大、面色苍白的临床表现，外周血涂片红细胞体积减小，应诊断为缺铁性贫血。在经有效治疗Hb恢复正常后，还需要继续药物治疗6～8周，目的是使储存铁（如铁蛋白）也恢复正常（E对）。